既有吸附又有分子筛作用的分离载体是
A. 硅胶
B. 聚酰胺
C. 氧化铝
D. 活性炭
E. 大孔树脂

正确答案：E。大孔树脂

解析：本题考查的是大孔吸附树脂的吸附原理。既有吸附又有分子筛作用的分离载体是大孔树脂（E对）。大孔吸附树脂的吸附原理：大孔吸附树脂具有选择性吸附和分子筛的性能。它的吸附性是由于范德华引力或产生氢键的结果，分子筛的性能是由其本身的多孔性网状结构决定的。硅胶（A错）有吸附作用，根据吸附能力大小不同进行分离。聚酰胺（B错）有吸附作用，聚酰胺吸附属于氢键吸附，力量较弱，介于物理吸附与化学吸附之间，也称半化学吸附。氧化铝（C错）有吸附作用，根据吸附能力大小不同进行分离。氧化铝又分为酸性或碱性氧化铝，如黄酮等酚酸性物质被碱性氧化铝的吸附，或生物碱被酸性氧化铝的吸附等，这又属于化学吸附。活性炭（D错）是非极性吸附剂，对非极性物质具有较强的亲和能力，在水中对溶质表现出强的吸附能力。